室内小气候对人体的直接作用是
A. 影响机体对疾病的抵抗力
B. 影响儿童、老人身心健康
C. 影响儿童的生长发育
D. 影响机体的体温调节
E. 影响居民休息和睡眠

正确答案：D。影响机体的体温调节

解析：本题考查室内小气候对人体的直接作用。室内小气候对人体的直接作用是影响机体的体温调节（D对ABCE错）。良好的小气候是维持机体热平衡，使体温调节处于正常状态的必要条件。相反，不良的小气候则可影响人体热平衡，使人体体温调节处于紧张状态，并影响机体其他系统的功能。